女，27岁，后仰摔倒左枕部着地，伤后昏迷，检查发现患者左枕部头皮血肿，右侧瞳孔5mm，光反射消失，左侧瞳孔2mm，左侧肢体偏瘫，右侧肢体有自主动作，正确诊断是
A. 左额颞硬膜下血肿并脑疝
B. 左额颞硬膜外血肿并脑疝
C. 左枕头皮血肿并右额颞硬膜外血肿
D. 左枕头皮血肿并左额颞硬膜下血肿
E. 右额颞硬膜下血肿并脑疝

正确答案：E。右额颞硬膜下血肿并脑疝

解析：青年女性患者，左枕部摔伤（提示可能有右额颞部对冲伤）后昏迷，检查见左枕部头皮血肿，右侧瞳孔5mm（正常值为3～4mm），光反射消失（提示右侧动眼神经麻痹），左侧瞳孔2mm（正常值为3～4mm），左侧肢体偏瘫，右侧肢体有自主动作（右侧瞳孔散大，左侧肢体偏瘫，提示脑疝），结合患者的病史、症状和查体，应诊断为右侧额颞部硬膜下血肿并小脑扁桃体疝（E对）。注意：硬膜外血肿多见于着力部位，而硬膜下血肿既可见于着力部位，也可见于对冲部位。